细辛除祛风散寒外，又能
A. 燥湿止带
B. 利水消肿
C. 温肺化饮
D. 消肿排脓
E. 升阳止泻

正确答案：C。温肺化饮

解析：本题考查细辛的功效。细辛除祛风散寒外，又能温肺化饮（C对）。细辛【功效】祛风散寒，通窍，止痛，温肺化饮。白芷【功效】发散风寒，通窍止痛，燥湿止带（A错），消肿排脓（D错）。郁李仁【功效】润肠通便，利水消肿（B错）。葛根【功效】解肌退热，透疹，生津，升阳止泻（E错）。